儿童几岁时会识性别
A. 1岁
B. 2岁
C. 3岁
D. 4岁
E. 5岁

正确答案：C。3岁

解析：本题考查神经心理发育与行为发展的相关内容。一般地，儿童在2岁时，会意识到男孩和女孩之间的身体差异即男女性在生理上的区别。大多数儿童3岁时（C对ABDE错）即可清晰地识别性别。